医疗保险基金主要由雇主和雇员按一定比例缴纳，政府适当补贴，这种模式属于
A. 国家医疗保险
B. 储蓄医疗保险
C. 商业医疗保险
D. 补充医疗保险
E. 社会医疗保险

正确答案：E。社会医疗保险

解析：社会医疗保险（E对），是国家通过立法形式强制实施，由雇主和雇员按一定比例缴纳保险费，政府适当补贴，建立社会医疗保险基金，支付雇员医疗费用的一种医疗保险制度。国家医疗保险（A错），是为补偿劳动者因疾病风险造成的经济损失而建立的一项社会保险制度。通过用人单位和个人缴费，建立医疗保险基金，参保人员患病就诊发生医疗费用后，由医疗保险经办机构给予一定的经济补偿，以避免或减轻劳动者因患病、治疗等所带来的经济风险。储蓄医疗保险（B错），是指强制性地以家庭为单位建立医疗储蓄基金，并逐步积累，用以支付日后患病所需的医疗费用。商业医疗保险（C错）是医疗保障体系的组成部分，单位和个人自愿参加。补充医疗保险（D错），是相对于基本医疗保险而言的，包括企业补充医疗保险、商业医疗保险、社会互助和社区医疗保险等多种形式，是基本医疗保险的有力补充，也是多层次医疗保障体系的重要组成部分。